根据《处方管理办法》的“四查十对”原则，查用药合理性，对
A. 临床诊断
B. 科别、姓名、年龄
C. 药品性状、用法用量
D. 药名、剂型、规格、数量

正确答案：A。临床诊断

解析：本题考查的是“四查十对”原则。根据《处方管理办法》的“四查十对”原则，查用药合理性，对临床诊断（A对）。药师调剂处方时必须做到“四查十对”：查处方，对科别、姓名、年龄（B错）；查药品，对药名、剂型、规格、数量（D错）；查配伍禁忌，对药品性状、用法用量（C错）；查用药合理性，对临床诊断。